男，43岁。外伤致右胸腔积血，胸腔穿刺抽出浑浊胸腔积液。此时主要治疗应是
A. 抗生素治疗
B. 补充血容量
C. 胸腔闭式引流
D. 伤口包扎固定
E. 对症支持治疗

正确答案：C。胸腔闭式引流

解析：青年男性患者，右胸腔积血，胸腔穿刺抽出浑浊胸腔积液，应诊断为右侧血胸。症状较轻的非进行性血胸多采用胸腔穿刺或闭式胸腔引流术治疗（C对）。伤口包扎固定（D错）、抗生素治疗（A错）、对症支持治疗（E错）均为血胸的一般辅助治疗，不是其主要治疗措施。患者无失血性休克表现，不需要补充血容量（B错）。